化妆品直接使用于皮肤，最常见的不良影响是引起
A. 化妆品皮肤病
B. 微生物感染
C. 眼部感染
D. 全身中毒
E. 皮肤癌

正确答案：A。化妆品皮肤病